具有辛开苦降，肝胃同治特点的方剂是
A. 半夏泻心汤
B. 半夏厚朴汤
C. 吴茱萸汤
D. 左金丸
E. 小陷胸汤

正确答案：D。左金丸

解析：左金丸方中重用苦寒之黄连为君药，一则清心火以泻肝火，即所谓“实则泻其子”，肝火得清，自不横逆犯胃；二则清胃热.胃火降则其气自降，如此标本兼顾，对肝火犯胃之呕吐吞酸尤为适宜。吴茱萸辛苦而温,入肝、脾、胃、肾经，辛能入肝散肝郁,苦能降逆助黄连降逆止呕之功，温则佐制黄连之寒，使黄连无凉遏之弊，且能引领黄连入肝经，为佐药。二药辛开苦降，寒热并用，泻火而不凉遏，温通而不助热，使肝火得清，胃气得降，则诸症自愈（D对）。半夏泻心汤配伍特点：寒热平调以和阴阳，辛开苦降以调气机，补泻兼施以顾虚实（A错）。半夏厚朴汤配伍特点：辛苦行降，痰气并治，行中有宣，降中有散（B错）。吴茱萸汤配伍特点：肝肾胃三经同治，温降补三法并施，以温降为主（C错）。小陷胸汤配伍特点：苦辛润相合，辛开苦降，润燥相得，消痰除痞，药简效专（E错）。